根据G.V.Black分类法，临床上Ⅳ类指的是
A. 所有牙面发育点裂隙沟的龋损所备成的窝洞
B. 发生于后牙邻面的龋损所备成的窝洞
C. 前牙邻面未累及切角的龋损所备成的窝洞
D. 为发生于所有牙齿近龈1/3牙面的龋损所制备的窝洞
E. 前牙邻面累及切角的龋损所备成的窝洞

正确答案：E。前牙邻面累及切角的龋损所备成的窝洞

解析：Ⅳ类洞：为发生于前牙邻面并损伤切角的龋损所制备的窝洞。包括切牙和尖牙的邻唇、邻腭（舌）面洞。目前，Ⅳ类洞含义已延伸，包括因牙外伤引起切角缺损的洞。掌握“银汞充填窝洞的概念”知识点。